急性化学中毒特点包括
A. 病变特异，演变迅速
B. 扩散迅速，受害广泛
C. 污染环境，不易洗消
D. 影响巨大，危害久远
E. 以上均正确

正确答案：E。以上均正确

解析：急性化学中毒特点：①发生突然，防救困难：②病变特异，演变迅速，可大规模杀伤人、畜；③扩散迅速，受害广泛；④污染环境，不易洗消；⑤影响巨大，危害久远。掌握“突发公共卫生事件”知识点。